决定肾结核的治疗方法，除全身情况外主要依据
A. 膀胱刺激症状
B. 血尿程度
C. 尿中找到结核杆菌
D. 膀胱镜检查所见
E. 静脉尿路造影或逆行肾盂造影

正确答案：E。静脉尿路造影或逆行肾盂造影

解析：肾结核的治疗应根据病人全身和病肾情况，选择药物治疗或手术治疗。静脉尿路造影或逆行肾盂造影（E对）可以清晰显露病灶部位充盈缺损情况，评估肾功能损伤程度与范围，了解分侧肾功能，对决定治疗肾结核的治疗方法必不可少。膀胱刺激症状（A错）和血尿程度（B错）其严重程度与肾脏疾病严重程度均无关，无法评估肾损伤程度。尿中是否找到结核杆菌（C错）只能用于肾结核的诊断，对于结核治疗方法的选择无指导作用。膀胱镜检查所见（D错）仅能观察膀胱和尿道受累的程度，无法观察肾脏病变情况。